汗证的病位在
A. 卫表肌腠
B. 肺
C. 心
D. 肾
E. 营分

正确答案：A。卫表肌腠

解析：汗证是指人体阴阳失调，腠理不固而使人体汗液外泄失常的病证。不因外界因素的影响，而白昼时时汗出，动辄益甚者，称为自汗。寐中汗出，行来汗止称为盗汗。所以汗证病位在卫表肌腠（A对）。以汗出增多为主要表现的病理变化主要由下列原因引起肺气不足，营卫不和，心血不足，阴虚火旺，邪热郁蒸。肺气不足：素体薄弱，病后体虚，或久患咳喘，耗伤肺气，肺主气属卫，肺气不足之人，肌表疏松，腠理不固而汗自出（B错）。心血不足：思虑太过，损伤心脾，或血证之后，血虚失养，均可导致心血不足（C错）。烦劳过度，亡血失精，或邪热耗阴，以致阴精亏虚，虚火内生，阴津被扰，不能内藏而外泄，导致自汗或盗汗（D错）。营卫不和：由于体内阴阳的偏盛偏衰，或风邪侵袭表虚之体，导致营卫失和，卫外失司而致汗出（E错）。